对B细胞共受体描述错误的是
A. 由CD19、CD21和CD81组成
B. 可与C3d结合
C. 提高B细胞对抗原刺激的敏感性
D. 与EB病毒选择性感染B细胞有关
E. 可减弱B细胞活化信号的转导

正确答案：E。可减弱B细胞活化信号的转导